直肠下部的会阴曲距肛门距离约
A. 1~3cm
B. 3~5cm
C. 5~7cm
D. 7~9cm
E. 9~11cm

正确答案：B。3~5cm

解析：会阴曲距离肛门约3～5cm(B对)，骶曲距肛门约7～9cm（D错）。